反映医疗需要量的指标不包括
A. 两周每千人患病人数
B. 两周每千人患病日数
C. 两周每千人因病伤卧床人数
D. 两周每千人就诊次数
E. 每人每年休工日数

正确答案：D。两周每千人就诊次数

解析：本题考查反映医疗需要量的指标。反映医疗需要量的指标包括：两周每千人患病人数（A对）；两周每千人患病日数（B对）；两周每千人因病伤卧床人数（C对）；每人每年休工日数（E对）。两周每千人就诊次数（D错，为本题正确答案）是反映居民对医疗卫生服务利用情况的指标。